面横裂发生的原因是
A. 下颌突未能相互融合
B. 上颌突与下颌突未能融合
C. 外侧腭突未能融合
D. 外侧腭突与内侧腭突未能融合
E. 上颌突与球状突未能融合

正确答案：B。上颌突与下颌突未能融合

解析：本题考查面横裂发生的原因。上颌突与下颌突未能融合（B对）形成面横裂。左右两侧下颌突未能相互融合（A错）产生下唇正中裂或下颌裂。上颌突与球状突未能融合（E错）形成唇裂。腭的形成是由原发腭突与继发腭突融合形成的，不存在外侧腭突与内侧腭突（CD错）的概念。